患者，女，31岁。3年来怀孕3次，均不足3个月而流产，听力减退，带下清稀，腰部痠痛，舌淡苔白，脉弱。其证候是
A. 肾气不固
B. 肾精不足
C. 肾阳虚
D. 中气下陷
E. 脾肾阳虚

正确答案：A。肾气不固

解析：肾气不固证以腰膝酸软，小便、精液、经带、胎气不固与气虚症状共见为辨证的依据。患者肾气亏虚，胎气不固，以致经常流产；肾气亏虚，腰膝、耳窍失养，则听力减退。腰膝酸软；带脉失固，则带下清稀；肾气虚，失于充养，则舌淡苔白，脉弱。故患者为肾气不固证（A对）。肾精不足证以生长发育迟缓、早衰、生育机能低下等为辨证的依据。此证中女子常常有经闭不孕的临床表现，而不会出现失于固摄的临床表现。患者滑胎流产为肾气不固，胎气不固的表现（B错）。肾阳虚证以腰膝酸冷、性欲减退、夜尿多与虚寒症状共见为辨证的依据，一般不会出现胎气不固的症状（C错）。中气下陷证指脾气虚弱，中气下陷，以脘腹重坠、内脏下垂及气虚症状为主要表现的证候。患者没有出现脏器下垂的症状（D错）。脾肾阳虚证指脾肾阳虚，虚寒内生，以久泻久痢、水肿、腰腹冷痛的为主要表现的证候。患者既没有出现虚寒症状，也没有出现久泻久痢等与脾阳虚相关的症状。患者出现了胎气不固的肾气不固证（E错）。